下列哪项不是肺炎心力衰竭的诊断要点
A. 心率突然超过180次/分
B. 呼吸突然加快，超过60次/分
C. 突然极度烦躁不安，发绀
D. 左肋缘下可扪及脾脏
E. 心音低钝，颈静脉怒张

正确答案：D。左肋缘下可扪及脾脏

解析：肺炎心力衰竭的诊断要点：心率突然超过180次/分（A对）、呼吸突然加快，超过60次/分（B对）、突然极度烦躁不安，发绀（C对）、心音低钝，颈静脉怒张（E对）。缺氧时肺小动脉反射性收缩，肺循环压力增高，肺动脉高压，使右心负担增加。肺动脉高压和中毒性心肌炎是诱发心力衰竭的主要原因。左肋缘下可扪及脾脏见于肝硬化（D错，为本题正确答案）。